下列有关重型肝炎的描述，正确的是
A. 急性重型肝炎和亚急性重型肝炎的主要区别是后者肝性脑病出现较早
B. 急性重型肝炎的病程一般不超过14天
C. 重型肝炎的病死率一般不高
D. 在我国以HBV感染所致重型肝炎最常见
E. 慢性重型肝炎是指重型肝炎的病程超过24周

正确答案：D。在我国以HBV感染所致重型肝炎最常见

解析：重型肝炎为全部病例的0.2%～0.5%，但病死率甚高，5型肝炎均可发展为重型肝炎，但以乙肝病毒感染最为常见（D对）。